具有升浮与沉降二向性的药是
A. 蔓荆子
B. 天花粉
C. 马齿苋
D. 胖大海
E. 鹤草芽

正确答案：D。胖大海

解析：本题考查中药的升降浮沉。具有升浮与沉降二向性的药是胖大海（D对）。药物的效用：药物的临床疗效是确定其升降浮沉的主要依据。病势趋向常表现为向上、向下、向外、向内，病位常表现为在上、在下、在外、在里；能够针对病情，改善或消除这些病证的药物，相应也具有向上、向下、向里、向外的不同作用趋向。有些药还表现为升浮与沉降皆具的二向性，如胖大海，既能清宣肺气、利咽而具升浮之性，又能清热解毒、通便而具沉降之性等。胖大海【性能特点】本品甘寒质轻，清宣润降。上入肺经而能清宣肺气，治肺失清肃之咳嗽、声哑；下入大肠经而能清热通便，治燥热便秘。然因力缓，故多用于轻症。蔓荆子（A错）【性能特点】本品辛散苦泄，微寒能清，质轻升浮，入膀胱、肝、胃经。上行头面，善散头面部风邪或风热之邪而清利头目，凡风在头面之疾皆可选用，兼热者尤宜；兼通络、利关节而止痛，疗痹痛拘急可投。天花粉（B错）【性能特点】本品微苦微寒清泄，甘酸益润，清润消溃，人肺、胃经。既清热生津止渴，又润肺燥、清肺热而止咳，还消散肿块、溃疮、促进脓液排出。清热不如石膏，生津不如知母，长于消肿溃脓。因兼酸味而有敛邪之嫌，故温热病不宜早用。马齿苋（C错）【性能特点】本品酸寒清解，质地滑利，入大肠经与肝经。既清解热毒、凉血，使热毒从内解；又滑肠，促使湿热或热毒尽快从大便排出；还利湿热而通淋，导热毒从小便出。善治】热痢与血痢，兼治血热出血与淋痛。药食兼用，味不苦易食，亦可作为减肥保健食品。鹤草芽（E错）【性能特点】本品苦泄降，凉能清，涩兼敛，入肝、小肠、大肠经。既善杀绦虫，又兼泻下而利于虫体排出，为治绦虫病之要药。